治疗右心室梗死所致低血压的最关键措施是
A. 扩张冠状动脉
B. 利尿治疗
C. 补充血容量
D. 控制心室率
E. 强心治疗

正确答案：C。补充血容量

解析：右心室心肌梗死的治疗措施与左心室梗死略有不同。右心室心肌梗死引起右心衰竭伴低血压，最关键措施是扩张血容量（C对）。